在免疫应答过程中，巨噬细胞
A. 产生抗体
B. 表达TCR
C. 产生细胞因子
D. 表达CD8分子
E. 发生基因重排

正确答案：C。产生细胞因子